呼吸功能不全是由于
A. 通气障碍所致
B. 换气障碍所致
C. V/Q比例失调所致
D. 外呼吸严重障碍所致
E. 内呼吸严重障碍所致

正确答案：D。外呼吸严重障碍所致

解析：呼吸功能不全是由于外呼吸功能严重障碍所致（D对），导致在海平面，静息呼吸状态下，出现PaO₂降低伴或不伴有PaCO₂增高的病理过程。